大黄的泻下成分主要是
A. 大黄素
B. 大黄酸
C. 大黄酚
D. 番泻叶苷A、B、C、D
E. 芦荟大黄素

正确答案：D。番泻叶苷A、B、C、D

解析：本题考查的是大黄的药理作用。大黄的泻下成分主要是番泻叶苷A、B、C、D（D对）。大黄中的主要蒽醌类成分及其化学结构：从大黄中分离得到蒽醌、二蒽酮、芪、苯丁酮、单宁、萘色酮等不同种类的80多种化合物，大体上可分为蒽醌类、多糖类与鞣质类。其中蒽醌类及其衍生物含量为3%～5%，分为游离型与结合型。游离型包括大黄酸（B错）、大黄素（A错）、土大黄素、芦荟大黄素（E错）、大黄素甲醚、异大黄素、大黄酚（C错）、虫漆酸D等。结合型主要包括蒽醌苷和双蒽酮苷。双蒽酮苷中有番泻苷A、B、C、D、E、F。《中国药典》以总蒽醌和游离蒽醌为指标成分，采用高效液相色谱法测定药材和饮片中芦荟大黄素、大黄酸、大黄素、大黄酚和大黄素甲醚等总蒽醌的含量，要求药材总蒽醌不得少于1.5%，游离蒽醌不得少于0.20%。大黄的药理作用：（1）泻下：大黄泻下作用明确，致泻的主要成分为结合型蒽醌苷，其中以二蒽酮苷中的番泻苷泻下作用最强。大黄酸蒽酮具有胆碱样作用，可兴奋肠平滑肌上M胆碱受体，促进结肠蠕动；大黄酸蒽酮抑制肠平滑肌细胞膜上Na⁺-K⁺-ATP酶，抑制Na⁺从肠腔转移至细胞内，使肠腔内渗透压升高，H₂O、Na⁺滞留，使肠腔容积扩大，机械性刺激肠壁，使肠蠕动增强而致泻。（2）抗菌：大黄酸、大黄素具有抗菌作用，大黄煎剂及其水、醇、醚提取物在体外对一些致病真菌有抑制作用。（3）抗炎：大黄煎剂对多种炎症动物模型均有抗炎作用，对炎症早期的渗出、水肿和炎症后期的结缔组织增生均有明显的抑制作用。（4）止血：大黄止血的有效成分主要有大黄酚、儿茶素和没食子酸等。